现代健康管理的新特点包括
A. 健康管理呈现多层次化，形成了多水平的健康管理系统
B. 健康管理的内容、对象和范围不断拓展
C. 健康管理手段日趋多样化
D. 强调横向与纵向健康管理和协调机制的建立
E. 以上都对

正确答案：E。以上都对

解析：本题考查现代健康管理的新特点。现代健康管理的新特点包括：①健康管理呈现多层次化，形成了多水平的健康管理系统；②健康管理的内容、对象和范围不断拓展；③健康管理手段日趋多样化；④强调横向与纵向健康管理和协调机制的建立。本题的选项均符合（E对ABCD错）。